有关内耳的描述，错误的是
A. 内耳是埋在颞骨岩部的一套复杂的管道系统
B. 骨迷路与膜迷路之间充满外淋巴
C. 膜迷路内充满内淋巴
D. 内、外淋巴借蜗孔相互交通
E. 椭圆囊

正确答案：D。内、外淋巴借蜗孔相互交通

解析：内耳位于颞骨岩部的骨质内，介于鼓室和内耳道底之间，其形状不规则，构造复杂，又称迷路（A对）。骨迷路与膜迷路之间充满外淋巴（B对），膜迷路内充满内淋巴（C对），内、外淋巴互不相通（D错，为本题正确答案）。膜迷路由椭圆囊（E对）和球囊、膜半规管和蜗管3 部分组成。